患儿咳嗽频作，喉痒声重，鼻塞流涕。其病机是
A. 风寒犯肺
B. 风热犯肺
C. 痰热内盛
D. 痰湿内停
E. 肺脾气虚

正确答案：A。风寒犯肺

解析：患儿风寒犯肺，肺气不宣，气机阻滞，故见咳嗽频作，喉痒声重，鼻塞流涕（A对）。风热犯肺则见咳嗽痰黄、口渴咽痛、鼻流浊涕（B错）。痰热内盛则见咳嗽痰多，色黄黏稠，难以咯出，甚则喉间痰鸣，发热口渴（C错）。痰湿内停则见咳嗽重浊，痰多，色白而稀，喉间痰声辘辘，胸闷纳呆，神乏困倦（D错）。肺脾气虚则见咳而无力，痰白清稀，面色苍白，气短懒言，语声低微，自汗畏寒，食少纳呆等（E错）。